颈椎病的鉴别诊断中，肩周炎不可能出现
A. 三角肌萎缩
B. 斜方肌痉挛
C. 肩痛及上臂痛
D. 前臂和手疼痛
E. 大范围活动时，疼痛加剧

正确答案：D。前臂和手疼痛

解析：肩周炎又称粘连性肩关节炎、冻结肩、五十肩，为肌肉和肌腱、滑囊以及关节囊发生的慢性损伤和炎症，致使肩盂肱关节囊炎性粘连、僵硬，以肩关节周围疼痛、各方向活动受限为特点。随着病程延长，疼痛范围扩大，可牵涉到上臂中段，出现肩痛和上臂痛（C对）。当大范围活动时，疼痛加剧（E对）。早期可出现冈上肌、斜方肌等肩周肌肉痉挛（B对），晚期可发生三角肌等的废用性萎缩（A对）。前臂和手疼痛、麻木，为神经根型颈椎病的临床表现，肩周炎一般不会出现（D错，为本题正确答案）。